体内代谢成乙酰亚胺醌，具有肝毒性的药物是
A. 可待因
B. 布洛芬
C. 对乙酰氨基酚
D. 乙酰半胱氨酸
E. 羧甲司坦

正确答案：C。对乙酰氨基酚

解析：本题考查对乙酰氨基酚。对乙酰氨基酚（C对）主要在肝脏代谢，大部分与葡萄糖醛酸及硫酸结合，从尿中排泄。少量生成有毒的N-羟基乙酰氨基酚，进一步转化成毒性代谢物N-乙酰亚胺醌。在正常情况下，N-乙酰基亚胺醌可与肝内的谷胱甘肽结合而解毒。若应用本品过量时，因谷胱甘肽被耗尽，代谢物即与肝蛋白结合，引起肝组织坏死。可待因（A错）主要在肝脏代谢，有10%的可待因脱甲基转变为吗啡而发挥镇咳、镇痛作用。布洛芬（B错）代谢迅速，其代谢主要发生在异丁基的ω-1 和ω-2氧化，首先氧化为醇，再氧化为酸。所有的代谢物都失活。乙酰半胱氨酸（D错）作为谷胱甘肽的类似物，用于对乙酰氨基酚中毒的解救。羧甲司坦（E错）为半胱氨酸的类似物，用作黏痰调节剂。